镇静药引起嗜睡、降糖药致低血糖，属于
A. 副作用
B. 毒性反应
C. 首剂效应
D. 药物本身作用
E. 变态反应

正确答案：D。药物本身作用